某农药动物实验的最大无作用剂量为10mg/（kg•bw），人和动物的种间差异为10，个体差异为10，该农药每日允许摄入量（ADI，mg/（kg•bw））是
A. 0.1
B. 1
C. 10
D. 100
E. 1000

正确答案：A。0.1